某男，57岁。自诉眩晕，动则加剧，常因劳累而加重，心悸少寐，入睡困难，神疲懒言，食欲不振，面色无华，舌淡，脉细弱。宜采用的治法是
A. 滋肾柔肝
B. 益气养血
C. 涤痰宣窍
D. 益气养阴
E. 益气健脾

正确答案：B。益气养血

解析：本题考查的是眩晕的辨证论治。自诉眩晕，动则加剧，常因劳累而加重，心悸少寐，入睡困难，神疲懒言，食欲不振，面色无华，舌淡，脉细弱。宜采用的治法是益气养血（B对）。眩晕是以头晕、眼花为主症的疾病。轻者闭目即止，重者如坐车船，旋转不定，不能站立，或伴恶心、呕吐、汗出、面色苍白等症，甚则突然晕倒。西医学的耳性眩晕（梅尼埃病、耳石症、晕动病）、脑性眩晕（椎-基底动脉供血不足、脑动脉粥样硬化）、颈源性眩晕（椎动脉型颈椎病）以及其他原因（血压异常、神经症、眼部疾患及外伤等）所致眩晕，均可参考此处辨证论治。（一）肝阳上亢证：【症状】眩晕，耳鸣，头目胀痛，口苦，失眠多梦，遇烦劳郁怒而加重，颜面潮红，急躁易怒。舌红苔黄，脉弦或数。【治法】平肝潜阳，滋养肝肾。（二）气血亏虚证：【症状】眩晕动则加剧，劳累即发，面色淡白，神疲乏力，倦怠懒言，唇甲不华，发色不泽，心悸少寐，纳少腹胀。舌淡苔薄白，脉细弱。【治法】补益气血，调养心脾。（三）肾精不足证：【症状】眩晕日久不愈，精神萎靡，两目干涩，视力减退，腰膝酸软，或遗精滑泄，耳鸣齿摇，颧红咽干，五心烦热。舌红少苔，脉细数。【治法】滋养肝肾，益精填髓。（四）痰湿中阻证：【症状】眩晕，头重昏蒙，或伴视物旋转，胸闷恶心，呕吐痰涎，食少多寐。舌苔白腻，脉濡。【治法】化痰祛湿，健脾和胃。益气养阴（D错）为胸痹气阴两虚证的治法。胸痹气阴两虚证：【症状】胸闷隐痛，时作时止，心悸气短，动则益甚，伴倦怠懒言，易汗出，头晕，失眠多梦。舌红或淡红，舌体胖且边有齿痕，苔薄白或少，脉细缓或结代。【治法】益气养阴，活血通脉。益气健脾（E错）为消渴气阴两虚证的治法。消渴气阴两虚证：【症状】口渴引饮，咽干口燥，多食善饥，倦怠乏力，便溏溲多，或形体消瘦。舌质淡红，苔白而干，脉弱。【治法】益气健脾，生津止渴。治法为滋肾柔肝（A错）或涤痰宣窍（C错）的病证，2022年考试指南未明确说明。